有机磷中毒的解救药物有
A. 硫代硫酸钠
B. 解磷定
C. 氯磷定
D. 双复磷
E. 双解磷

正确答案：B、C、D、E。解磷定；氯磷定；双复磷；双解磷

解析：本题考查有机磷中毒解救。解救有机磷中毒的药物主要分为两类，一类是解磷定（B对）、双复磷（D对）、氯磷定（C对）、双解磷（E对）等胆碱酯酶复能剂，另一类是胆碱能神经抑制剂山莨菪碱、阿托品等。硫代硫酸钠（A错）主要用于氰化物中毒，也用于砷、汞、铅中毒等。